磺胺甲噁唑（SMZ）和甲氧苄啶（TMP）代谢拮抗叶酸的生物合成通路
A. 都作用于二氢叶酸还原酶
B. 都作用于二氢叶酸合成酶
C. 前者作用于二氢叶酸还原酶，后者作用于二氢叶酸合成酶
D. 前者作用于二氢叶酸合成酶，后者作用于二氢叶酸还原酶
E. 干扰细菌对叶酸的摄取

正确答案：D。前者作用于二氢叶酸合成酶，后者作用于二氢叶酸还原酶

解析：本题考查磺胺甲噁唑和甲氧苄啶的作用机理。磺胺甲噁唑（SMZ）和甲氧苄啶（TMP）代谢拮抗叶酸的生物合成通路是前者作用于二氢叶酸合成酶，后者作用于二氢叶酸还原酶（D对）。磺胺甲噁唑的作用机理是通过与PABA竞争二氢叶酸合成酶，阻止细菌二氢叶酸的合成，继而使二氢叶酸和四氢叶酸合成减少，从而干扰细菌体内DNA、RNA以及蛋白质的合成达到抑菌作用。甲氧苄啶的作用机制为抑制细菌二氢叶酸还原酶，导致四氢叶酸生成减少，影响辅酶F的形成，从而阻断细菌体内DNA、RNA以及蛋白质的合成达到抑菌作用。故磺胺甲噁唑（SMZ）代谢拮抗叶酸的生物合成通路为抑制二氢叶酸合成酶，甲氧苄啶（TMP）代谢拮抗叶酸的生物合成通路为抑制二氢叶酸还原酶。